既退虚热，又凉血、解暑的药是
A. 白薇
B. 青蒿
C. 地骨皮
D. 牡丹皮
E. 银柴胡

正确答案：B。青蒿

解析：本题考查青蒿的功效。既退虚热，又凉血、解暑的药是青蒿（B对）。青蒿【功效】退虚热，凉血，解暑，截疟。白薇（A错）【功效】退虚热，凉血清热，利尿通淋，解毒疗疮。地骨皮（C错）【功效】退虚热，凉血，清肺降火，生津。牡丹皮（D错）【功效】清热凉血，活血散瘀，退虚热。银柴胡（E错）【功效】退虚热，清疳热。